女性，40岁。左侧上颌后牙出现自发性、持续性钝痛4天。咬硬物时疼痛明显。口腔检查：左上5（牙合）面深龋，探诊（-），叩诊（++），松动I°，牙周检查（-）。温度刺激试验无反应。可拟诊为
A. 急性浆液性根尖周炎
B. 急性浆液性牙髓炎
C. 急性化脓性根尖周炎
D. 急性化脓性牙髓炎
E. 急性牙周膜炎

正确答案：A。急性浆液性根尖周炎

解析：本题考查急性浆液性根尖周炎。女性，40岁。左侧上颌后牙出现自发性、持续性钝痛4天。咬硬物时疼痛明显。口腔检查：左上5（牙合）面深龋，探诊（-），叩诊（++），松动I°，牙周检查（-）。温度刺激试验无反应。可拟诊为急性浆液性根尖周炎（A对）。急性浆液性牙髓炎和急性化脓性牙髓炎均属牙髓炎，疼痛剧烈，为自发性阵发性疼痛，冷热刺激加剧疼痛，探诊可引起剧烈疼痛，叩诊不适，且急性化脓性牙髓炎可出现热痛冷缓解的症状（BD错）。急性化脓性根尖周炎为自发性，剧烈持续的跳痛，患牙叩痛（++）—（+++），松动度Ⅱ°—Ⅲ°（C错）。急性牙周膜炎为急性根尖周炎或牙周脓肿等可使牙明显松动，这是由于牙周膜充血水肿及渗出物所致，急性炎症消退后牙齿 可恢复稳固（E错）。